提取和分离黄酮类成分常用方法
A. 酸提碱沉法
B. 硅胶柱色谱法
C. PH梯度萃取法
D. 碱提酸沉法
E. 聚酰胺柱色谱法

正确答案：B、C、D、E。硅胶柱色谱法；PH梯度萃取法；碱提酸沉法；聚酰胺柱色谱法

解析：本题考查黄酮类的提取分离方法。提取和分离黄酮类成分常用方法硅胶柱色谱法（B对）、PH梯度萃取法（C对）、碱提酸沉法（D对）、聚酰胺柱色谱法（E对）。黄酮类的分离方法有溶剂萃取法、PH梯度萃取法、柱色谱法、高效液相色谱法、超临界流体色谱法。柱色谱法：柱色谱的填充剂有硅胶、聚酰胺、大孔吸附树脂、氧化铝、葡聚糖凝胶和纤维素粉等，其中以硅胶、聚酰胺最常用。黄酮类化合物的提取方法：乙醇或甲醇提取法、热水提取法、碱性水或碱性稀醇提取法、超临界萃取法。